以下选项中颊侧骨板厚于舌侧的是
A. 下颌中切牙
B. 下颌尖牙
C. 下颌第一前磨牙
D. 下颌第二前磨牙
E. 下颌第一磨牙

正确答案：E。下颌第一磨牙

解析：本题考查下颌骨及腭骨解剖特点。下颌前牙唇侧牙槽窝骨板比舌侧薄，前磨牙区颊舌侧骨板厚度相近，磨牙区颊侧骨板厚于舌侧（E对）。